痫病与五脏均有关联，但主要责之于
A. 肺、脾
B. 肝、肾
C. 心、肝
D. 肺、肾
E. 肝、脾

正确答案：C。心、肝

解析：痫病的发生大多由于七情失调，先天因素，脑部外伤，饮食不节，劳累过度，或患它病之后，造成脏腑失调，痰浊阻滞，气机逆乱，风阳内动所致，尤其与痰邪关系最为密切，与五脏均有关联，顽痰闭阻心窍，肝经风火内动是痫病的主要病机特点，故主要责之于心肝（C对ABDE错）。